在家兔动脉血压实验中，夹闭一侧颈总动脉引起全身动脉血压升高，其主要原因是
A. 血管容积减少，相对血容量增多
B. 颈动脉窦受到牵拉刺激
C. 颈动脉体受到牵拉刺激
D. 颈动脉窦内压力降低
E. 颈动脉体内压力降低

正确答案：D。颈动脉窦内压力降低